强心苷治疗慢性心功能不全的最基本作用是
A. 使已扩大的心室容积缩小
B. 增加心肌收缩力
C. 增加心室工作效率
D. 降低心率
E. 增加心率

正确答案：B。增加心肌收缩力

解析：强心苷可直接作用于心脏，发挥正性肌力作用，在心脏前后负荷不变的条件下，心肌收缩力增加（B对），心脏每搏做功明显增加，搏出量增加，从而增加衰竭心脏的心输出量。强心苷具有增强心肌收缩力、减慢心率、降低心肌耗氧的作用，均有利于缓解心衰症状，同时还能影响心肌电生理，收缩血管平滑肌以及抑制肾素-血管紧张素-醛固酮系统，抑制心肌细胞肥大以及心室重构，对心室容积（A错）以及心室工作效率（C错）无影响。CHF时心肌收缩无力，心输出量减少，交感神经代偿性兴奋，心率加快，治疗量的强心苷使心肌收缩力加强，心输出增加，从而刺激主动脉弓和颈动脉窦压力感受器，反射性兴奋迷走，交感神经兴奋性降低，减慢心率（DE错）。